不是中和抗体抗病毒的作用机制是
A. 阻止病毒吸附和侵入易感细胞
B. 与病毒形成免疫复合物易被吞噬
C. 阻止无包膜病毒脱壳
D. 与病毒表面抗原结合，激活补体，使细胞溶解
E. 活化杀伤T细胞（CTL）释放淋巴因子

正确答案：E。活化杀伤T细胞（CTL）释放淋巴因子